患者，男性，35岁。左下第一磨牙拔除5个月，拟行种植义齿修复。最佳的种植体材料为
A. 钛
B. 钴铬合金
C. 镍铬合金
D. 不锈钢
E. 金合金

正确答案：A。钛

解析：钛及钛合金由于具有良好的生物学性能和理想的力学性能，成为目前应用最广、最受青睐的种植体金属材料。掌握“牙种植手术及效果评估”知识点。